以下哪种不属于癌前病变
A. 鲜红斑痣
B. 白斑
C. 红斑
D. 扁平苔藓
E. 乳头状瘤

正确答案：A。鲜红斑痣

解析：本题考查癌前病变。鲜红斑痣（A错，为本题的正确答案）不属于癌前病变。鲜红斑痣即微静脉畸形，俗称葡萄酒色斑，是无数扩张的后微静脉所组成的较扁平而很少隆起的斑块，属于脉管畸形，无癌变的可能，不属于癌前病变。白斑（B对）、红斑（C对）、扁平苔藓（D对）都是口腔颌面部最常见的癌前病变，还有口腔黏膜下纤维性变、盘状红斑狼疮、上皮过角化、先天性角化不良等。乳头状瘤（E对）主要是外生性乳头状生长，在形态学上有一定的浸润性，有癌变的可能，也属于癌前病变。